牙冠表面细长形的釉质隆起成为
A. 牙尖
B. 牙体长轴
C. 嵴
D. 沟
E. 窝

正确答案：C。嵴

解析：嵴：为牙冠表面细长形的釉质隆起。掌握“牙的萌出、更替及牙体解剖名词、标志”知识点。